烷化剂对DNA的烷化作用最常发生在
A. 鸟嘌呤的O-6位
B. 鸟嘌呤的N-7位
C. 腺嘌呤的N-1位
D. 腺嘌呤的N-3位
E. 腺嘌呤的N-7位

正确答案：B。鸟嘌呤的N-7位